香薷的功效是
A. 发散风寒，通窍止痛
B. 发汗解表，和中化湿
C. 发表散寒，祛风胜湿
D. 祛风散寒，化痰止咳
E. 散风解表，透疹止痒

正确答案：B。发汗解表，和中化湿

解析：本题考查的是香薷的功效。香薷的功效是发汗解表，和中化湿（B对）。香薷：【功效】发汗解表，和中化湿，利水消肿。白芷：【功效】发散风寒，通窍止痛（A错），燥湿止带，消肿排脓。藁本：【功效】发表散寒，祛风胜湿（C错），止痛。荆芥：【功效】散风解表，透疹止痒（E错），止血。功效为祛风散寒，化痰止咳（D错）的中药，2022年考试指南未明确说明。